冠状动脉粥样硬化的好发部位是
A. 左旋支
B. 左前降支
C. 右冠状动脉后降支
D. 右冠状动脉
E. 左冠状动脉主干

正确答案：B。左前降支

解析：左前降支成为冠状动脉粥样硬化的好发处的原因有：①左室壁厚、工作量大，左室所需氧及营养物质多，左冠的管径大，分支多、总容积大。②左前降支走行于心肌表面，靠近心肌侧，缓冲余地小，内皮细胞受血流冲击而损伤的几率大。根据病变检出率和统计结果，各个部位好发几率排序如下：左冠状动脉前降支（B对）＞右主干（右冠状动脉主干）（D错）＞左主干（左冠状动脉主干）（E错）或左旋支（A错）＞后降支（右冠状动脉后降支）（C错）。